下列哪项是戊型肝炎病毒的主要传播途径
A. 注射、输血
B. 蚊虫叮咬传播
C. 唾液传播
D. 垂直传播
E. 粪-口传播

正确答案：E。粪-口传播

解析：甲型、戊型肝炎以粪-口传播为主；乙型肝炎主要通过血液和血制品传播、接触（日常生活密切接触和性接触）传播和母婴传播。丙型肝炎亦主要经血液和血制品传播。掌握“病毒性肝炎”知识点。